不符合“人人享有卫生保健”内涵的是
A. 卫生资源公平分配
B. 不发达地区的人们也能享受到基本的卫生保健服务
C. 为人们治愈所有疾病
D. 尽可能控制影响健康的危险因素
E. 力争使人们的生理、心理和社会适应都达到完好的状态

正确答案：C。为人们治愈所有疾病

解析：1977年，第30届世界卫生大会提出了“2000年人人享有卫生保健”的全球卫生战略目标。即“到2000年使世界全体人民都能享有基本的卫生保健服务，并且通过消除和控制影响健康的各种有害因素（D对），使人们都能享有在社会和经济生活方面均富有成效的健康水平，达到身体、精神和社会适应的完好状态”（E对）。世界全体人民都能享有基本的卫生保健服务当然包括发达国家、发展中国家和不发达国家（B对）。人人享有卫生保健要求能够公平地分配一切卫生资源（A对），它是指人们必须在工作和生活场所能保持健康，并不是治愈全部疾病，也不是不再有人生病或残疾（C错，为本题正确答案）。